从哪个时期开始个体自我意识开始发展
A. 胎儿期
B. 婴儿期
C. 幼儿期
D. 学龄期
E. 青春期

正确答案：B。婴儿期

解析：一般婴儿在半岁左右开始能分辨自身与外界事物；1岁时有了自我认定，觉察到名字与身体是同一体；2岁的儿童开始有独立的愿望，并有被尊重的需要；4-6岁时出现自我评价，并以道德感作为行为好坏的标准。掌握“人格”知识点。